从尖对尖位下颌还可以继续向外侧移动至最大侧向运动的位置，称为
A. 最大侧向颌位
B. 侧（牙合）颌位
C. 非工作侧（牙合）干扰
D. 侧向平衡（牙合）
E. 最大前伸颌位

正确答案：A。最大侧向颌位

解析：从尖对尖位下颌还可以继续向外侧移动至最大侧向运动的位置，称为最大侧向颌位，这是下颌侧向运动的极限位。掌握“下颌姿势位、三类颌位与前伸、侧方（牙合）颌位”知识点。